胆汁中促进脂肪消化吸收的主要成分是
A. 胆盐
B. 胆固醇
C. 胆色素
D. 脂肪酶
E. 脂肪酸

正确答案：A。胆盐